青霉素可用于
A. 治疗草绿色链球菌、肠球菌所致的心内膜炎
B. 治疗钩端螺旋体病
C. 治疗真菌感染
D. 治疗G⁻杆菌引起的感染
E. 治疗溶血性链球菌、肺炎球菌所致的扁桃体炎、大叶性肺炎

正确答案：A、B、E。治疗草绿色链球菌、肠球菌所致的心内膜炎；治疗钩端螺旋体病；治疗溶血性链球菌、肺炎球菌所致的扁桃体炎、大叶性肺炎